下列哪项的轻度为悬雍垂裂
A. 唇裂
B. 腭裂
C. 颌裂
D. 下颌裂
E. 斜面裂

正确答案：B。腭裂

解析：腭裂的程度在轻者可仅为悬雍垂裂。掌握“腭部与舌的发育”知识点。